根面龋有可能开始于牙骨质或者下列哪项的表面
A. 牙釉质
B. 牙本质
C. 牙髓
D. 牙周膜
E. 牙槽骨

正确答案：B。牙本质

解析：根面龋始于牙骨质或牙本质表面。掌握“龋病的临床表现与分类”知识点。